可见肾虚证的月经病有
A. 月经先期
B. 月经后期
C. 月经先后无定期
D. 月经过少
E. 崩漏

正确答案：A、B、C、D、E。月经先期；月经后期；月经先后无定期；月经过少；崩漏

解析：本题考查的是中医妇科常见病的辨证论治。可见肾虚证的月经病有月经先期（A对）、月经后期（B对）、月经先后无定期（C对）、月经过少（D对）、崩漏（E对）。月经先期的辨证有脾气虚证、肾气虚证、肝郁血热证。月经后期的辨证有肾虚证、血虚证、气滞证、痰湿证。月经先后无定期的辨证有肾虚证、肝郁证、脾虚证。月经过少的辨证有肾虚证、气血亏虚证、痰湿证、血瘀证。崩漏的辨证有气血两虚证、脾不统血证、肝肾不足证、瘀血阻络证。